诸湿肿满，皆属于
A. 肺
B. 肾
C. 心
D. 肝
E. 脾

正确答案：E。脾

解析：“诸湿肿满，皆属于脾”句的意思是多种出现肌肤肿胀、腹部胀满等之湿类病证，其病机大多属于脾。因脾为湿土之脏，主运化水湿，主四肢，应大腹，若脾失健运，水津失布，内聚中焦或泛溢肌肤，则见脘腹胀满、四肢浮肿（E对）。诸气膹郁，皆属于肺（A错）。诸寒收引，皆属于肾（B错）。诸痛痒疮，皆属于心（C错）。诸风掉眩，皆属于肝（D错）。